脑血管疾病中发病最快者为
A. 脑出血
B. 蛛网膜下腔出血
C. 脑血栓形成
D. 脑栓塞
E. 脑室出血

正确答案：D。脑栓塞